通过海绵窦外壁的脑神经
A. III、IV、V、V1对脑神经
B. III、IV、V对脑神经
C. III、IV、VI对脑神经
D. III、IV对及眼神经、上颌神经
E. 无

正确答案：D。III、IV对及眼神经、上颌神经

解析：通过海绵窦外壁的脑神经是III、IV对及眼神经、上颌神经（D对）。